关于普罗帕酮叙述错误的是
A. 阻滞Na⁺内流，降低自律性
B. 降低0相去极化速度和幅度，减慢传导
C. 有普鲁卡因样局麻作用
D. 弱的β受体阻断作用，减慢心率，抑制心肌收缩力
E. 促进K⁺外流，相对延长有效不应期

正确答案：E。促进K⁺外流，相对延长有效不应期

解析：本题考查普罗帕酮。普罗帕酮无促进K⁺外流的电生理效应（E错，为本题正确答案）。普罗帕酮属于Ⅰc类抗心律失常药，主要通过抑制钠离子内流，发挥作用（A对）。普罗帕酮能降低动作电位0相上升速率和幅度，减慢传导（B对），同时有有弱的肾上腺素受体阻断作用（D对），减慢心率，抑制心肌收缩力，有普鲁卡因样局麻作用（C对）。